用HClO₄滴定液测定盐酸麻黄碱所用的指示液是
A. 硫酸铁铵
B. 结晶紫
C. 淀粉
D. 二甲酚橙
E. 酚酞

正确答案：B。结晶紫

解析：本题考查滴定。用HClO₄滴定液测定盐酸麻黄碱所用的指示液是结晶紫（B对）。用HClO₄滴定液滴定盐酸麻黄碱的方法属于非水溶液滴定法中的非水碱量法，通常以冰醋酸或醋酸-醋酐为溶剂，用高氯酸的冰醋酸溶液为滴定液滴定，以结晶紫或电位法指示滴定终点。硫酸铁铵（A错）为银量法测定氯的含量时的指示剂。淀粉（C错）是碘量法的指示剂。二甲酚橙（D错）是络合反应的指示剂。酚酞（E错）为酸碱中和反应的指示剂。